女婴，3个月。高热，频繁呕吐3天，嗜睡。查体：双眼凝视，反应差，脐部见少量脓性分泌物，前囟膨隆，心肺正常，脑膜刺激征（+）。该患儿最易出现的并发症是
A. 脑积水
B. 智力低下
C. 硬脑膜下积液
D. 低钙抽搐
E. 脑萎缩

正确答案：C。硬脑膜下积液

解析：患婴高热，脐部见少量脓性分泌物，提示体内有原发感染灶。患婴频繁呕吐、前囟膨隆，提示颅内压增高。患婴嗜睡、双眼凝视、反应差，应考虑化脓性脑膜炎，原发灶为脐部化脓性感染。该患儿的最可能的诊断为化脓性脑膜炎。约30%-～%的化脓性脑膜炎并发硬膜下积液，为化脑最常见的并发症（C对）。化脑的其他并发症包括脑室管膜炎、脑积水、抗利尿激素异常分泌综合征、各种神经功能障碍（智力低下、脑性瘫痪、癫痫、视力障碍和行为异常等）等。